以下眼疾与玻璃体病变关系最为密切的是
A. 白内障
B. 青光眼
C. 视网膜剥离
D. 色盲
E. 斜视

正确答案：C。视网膜剥离

解析：白内障（A错）是指晶状体若因疾病或创伤而变混浊。青光眼（B错）是指房水代谢紊乱或循环不畅而造成的眼内压增高。视网膜剥离（C对）由于玻璃体的支撑作用减弱而导致，即与玻璃体病变关系最为密切。